属于麻醉药品的是
A. 氨酚待因片
B. 氨酚氢可酮片
C. 氢可酮
D. 氯胺酮

正确答案：C。氢可酮

解析：本题考查麻醉药品目录。属于麻醉药品的是氢可酮（C对）。《麻醉药品品种目录（2013版）》共121个品种，其中我国生产及使用的品种及包括的制剂、提取物、提取物粉共有27个品种，具体有以下品种。1.可卡因2.罂粟浓缩物（包括器粟果提取物、罂粟果提取物粉）3.二氢埃托啡4.地芬诺酯5.芬太尼6.氢可酮7.氢吗啡酮8.美沙酮9.吗啡（包括吗啡阿托品注射液）10.阿片（包括复方樟脑酊、阿桔片）11.羟考酮12.哌替啶13.瑞芬太尼14.舒芬太尼15.蒂巴因16.可待因17.右丙氧芬18.双氢可待因19.乙基吗啡20.福尔可定21.布桂嗪22.罂粟壳。氨酚待因片（A错）为含特殊药品复方制剂。氨酚氢可酮片（B错）为第二类精神药品。氯胺酮（D错）为第一类精神药品。